一位48岁妇女，近2年经常出现出汗、潮热，偶尔烦躁，月经周期延长，经期缩短，月经量减少，现已停经近10个月，到医院进行咨询。请判断这位妇女是属于
A. 绝经前期
B. 绝经后期
C. 绝经过渡期
D. 人工绝经
E. 卵巢早衰

正确答案：B。绝经后期

解析：本题考查更年期的相关内容。该妇女48岁，近2年经常出现出汗、潮热，偶尔烦躁，月经周期延长，经期缩短，月经量减少，现已停经近10个月等情况可推断出这位妇女是属于绝经后期（B对）。绝经前期（A错）是指绝经前的整个生殖期。绝经过渡期（C错）指绝经前的一段时期，即从生育期走向绝经的一段过渡时期，包括从临床特征、内分泌学及生物学开始出现绝经趋势的迹象（即卵巢功能开始衰退的征兆），一直到最后一次月经。人工绝经（D错）指手术切除双侧卵巢，或因医源性丧失卵巢功能（如化学治疗或放射治疗）后月经终止。卵巢早衰（E错）是指40岁以内卵巢功能衰退。